伤寒第3～4周时阳性率最高的是
A. 骨髓培养
B. 血培养
C. 尿培养
D. 大便培养
E. 肥达反应

正确答案：D。大便培养